人居环境建设的目标是
A. 充分运用规划手段，建设可持续发展的、宜人的居住环境
B. 使人类达到生态环境的满足
C. 使人类达到人文环境的满足
D. A＋B
E. A＋B＋C

正确答案：E。A＋B＋C

解析：本题考查人居环境建设的目标。人居环境建设的目标是充分运用规划手段，建设可持续发展的、宜人的居住环境，使人类达到作为生物的人在生物圈内生存的多种条件的满足，即生态环境的满足，以及作为社会人在社会文化环境中多种需求的满足，即人文环境的满足（E对ABCD错）。